可反映肝硬化患者肝功能的血清检查是
A. 丙氨酸氨基转氨酶
B. γ-谷氨酰转氨酶
C. 白蛋白
D. 碱性磷酸酶
E. 胆红素

正确答案：C。白蛋白

解析：白蛋白仅由肝细胞合成，正常成人合成白蛋白10～16g/d，血清白蛋白35～55g/L，肝脏合成功能降低时，血清白蛋白明显降低，故白蛋白是反映肝硬化肝脏合成功能减退的指标（C对）。丙氨酸氨基转氨酶（ALT）、γ-谷氨酰转氨酶是反映肝细胞损伤的重要指标（AB错）。碱性磷酸酶反映肝脏胆汁排出是否受阻（D错）。胆红素测定有助于检出肉眼尚不能观察到的黄疸，常反映肝细胞损伤或胆汁淤积（E错）。补充知识点：反映肝脏合成功能的指标有血清白蛋白、血浆凝血因子、胆固醇等；反映肝细胞膜通透性的指标有丙氨酸氨基转氨酶（ALT）、天冬氨酸氨基转氨酶（AST）、γ-谷氨酰转氨酶、乳酸脱氢酶（LDH）等；反映胆汁淤积或肝细胞损伤的指标为胆红素。